在窒息性有毒气体中，毒性最强的是
A. 氮气
B. 甲烷
C. 二氧化碳
D. 水蒸气
E. 氰化氢

正确答案：E。氰化氢